关于反转录病毒的性状，哪项错误
A. 均含有反转录酶
B. 均侵犯CD4⁺细胞
C. 有包膜DNA病毒
D. 复制时先形成RNA/DNA中间体
E. 基因组易发生变异

正确答案：C。有包膜DNA病毒